HAV有几个血清型
A. 1个
B. 2个
C. 3个
D. 7个
E. 24个

正确答案：A。1个

解析：HAV只有一个血清型，但有1～Ⅶ7个基因型，其中Ⅳ、V、Ⅵ为感染猴的基因型，Ⅰ、Ⅱ、Ⅲ和Ⅶ基因型为感染人的HAV，中国流行株多为Ⅰ基因型。掌握“甲型肝炎病毒”知识点。